药品在库房存放时应
A. 每分钟至少记录一次
B. 每5分钟至少记录一次
C. 每2分钟至少记录一次
D. 每30分钟至少记录一次

正确答案：D。每30分钟至少记录一次

解析：本题考查温湿度自动监测的数据记录频次。药品在库房存放时应每30分钟至少记录一次（D对）。系统应当自动对药品储存运输过程中的温湿度进行不间断监测和记录，测点温湿度数据每分钟至少更新采集1次（A错）。监测数据记录频次为：储存状态下每30分钟至少记录1次温湿度数据，运输状态下每5分钟至少记录1次温度数据（B错）；发生超温超湿状况时，系统变频至每2分钟至少记录1次监测数据（C错）。